虽小便不利但无舌红口渴，但伴有神疲乏力，面色萎黄或淡白，脉虚弱，舌淡胖嫩，属
A. 真实假虚
B. 实证转虚
C. 真虚假实
D. 虚证转实
E. 虚实夹杂

正确答案：C。真虚假实

解析：患者小便不利但无舌红口渴是实证的表现，但伴有神疲乏力，面色萎黄或淡白，脉虚弱，舌淡胖嫩的虚证表现，所以该患者表面是实证，但实质是虚证，符合真虚假实的的临床表现（C对）。真实假虚证是指疾病的本质为实证，却出现某些“虚羸”的现象，即所谓“大实有羸状”（A错）。实证转虚指原为实证，后出现虚证，而实证随之消失（B错）。虚证转实指正气不足，脏腑机能衰退，组织失却濡润充养，或气机运化无力，以致气血阻滞，病理产物蓄积，邪实上升为矛盾的主要方面，而表现以实为主的证（D错）。虚实夹杂是指在同一患者身上，既有虚证，又有实证的情况（E错）。